患者，65岁，查体：心尖搏动出现在剑突下，且深吸气时增强，肺动脉瓣第二心音增强。应首先考虑的是
A. 冠心病
B. 高血压性心脏病
C. 风心病
D. 肺心病
E. 心肌炎

正确答案：D。肺心病

解析：患者系老年男性，是肺心病的高发年龄，查体示肺动脉瓣第二心音增强，即P2＞A2，心尖搏动出现在剑突下，且深吸气时增强，应首先考虑的是肺心病（D对）。冠心病（A错）是指冠状动脉发生粥样硬化引起管腔狭窄或闭塞，导致心肌缺血缺氧或坏死而引起的心脏病，多发于40岁以上成人，体征主要为发病时心前区疼痛，心率增快，血压升高及二尖瓣收缩期杂音等心肌缺血的表现。高血压性心脏病（B错）是指高血压长期控制不佳而引起的心脏结构和功能的改变，体征主要有心尖搏动增强呈抬举性，心界向左下扩大，主动脉瓣区第二心音亢进呈金属调等。风心病（C错）初期可无明显症状，后期则表现为心慌气短、乏力、咳嗽、咳粉红色泡沫样痰等心功能失代偿的表现，初发年龄多在5～15岁，体征主要有心脏普遍增大，心尖部第一心音减弱，舒张期奔马率，双肺底可出现细湿啰音等心力衰竭体征。心肌炎（E错）患者多见于病毒感染，体征主要有心律失常，以房性与室性期前收缩及房室传导阻滞最为多见，心率可增快与体温不相称，听诊常闻及第三、四心音或奔马率等。